选定暴露和未暴露于某种因素的两种人群，追踪其各自的发病结局，比较两者发病结局的差异，从而判断暴露因素与发病有无因果关联及关联程度，该研究为
A. 队列研究
B. 病例对照研究
C. 现况调查研究
D. 临床试验研究
E. 现场干预试验

正确答案：A。队列研究

解析：选定暴露和未暴露于某种因素的两种人群，追踪其各自的发病结局，比较两者发病结局的差异，从而判断暴露因素与发病有无因果关联及关联程度，即队列研究（A对）。病例对照研究和队列研究同属流行病学的分析性研究，但病例对照研究按是否患病将研究对象分组，了解他们对研究因素的暴露有无差别，而不是像本题一样按暴露因素有无分组，前瞻性地观察他们发病水平有无差别（B错）。现况调查研究即横断面研究，它收集的资料是某一时间横断面上的，暴露与结局同时调查，并不像本题描述一样的对人群进行追踪调查其各自的结局（C错）。临床试验研究和现场干预试验均属于流行病学实验性研究，它们和队列研究不同的是有人为施加的干预措施（DE错）。